关于大段损伤的描述错误的是
A. DNA链大段缺失
B. 跨越基因的损伤
C. DNA断裂
D. 光镜下可见

正确答案：D。光镜下可见

解析：本题考查大段损伤。大段损伤是指DNA链大段缺失（A对）与插入；DNA断裂（C对）；跨越基因的损伤（B对）。大段损伤属于基因突变，在光镜下不可见（D错，为本题正确答案）。